生后24小时内出现黄疸
A. 生理性黄疸
B. 母乳性黄疸
C. 病理性黄疸
D. 新生儿败血症
E. 胆道闭锁

正确答案：C。病理性黄疸

解析：新生儿出生后24小时内出现黄疸应视为病理性黄疸（C对）。生理性黄疸在新生儿出生后2～3天出现（A错）。母乳性黄疸一般发生在宝宝出生后的第一周或者第二周（B错）。新生儿败血症分早发型和晚发型，早发型多在出生后七天以内起病，感染多发生于出生前和出生时。晚发型常在出生七天以后起病，感染发生在出生时和出生后（D错）。新生儿胆道闭锁症状一般在生后一个月左右表现出来（E错）。